非霍奇金淋巴瘤化疗首选的方案是
A. MP方案
B. CHOP方案
C. MOPP方案
D. VDP方案
E. DA方案

正确答案：B。CHOP方案

解析：非霍奇金淋巴瘤化疗首选的方案是CHOP方案（B对）。MP方案（A错）是多发性骨髓瘤的传统化疗方案；MOPP方案（P585）（C错）是ABVD方案出现之前霍奇金淋巴瘤的首选化疗方案；VDP方案（P575）（D错）是急淋的常用化疗方案；DA方案（P576）（E错）是急性髓系白血病最常用的化疗方案。